尼龙丝刷毛的优点不包括哪一项
A. 毛端呈圆形，对牙清洁作用及牙的按摩作用均佳
B. 弹性好
C. 耐磨
D. 吸水性差
E. 高温下不易卷毛

正确答案：E。高温下不易卷毛

解析：本题考查尼龙丝刷毛的优点。尼龙丝刷毛高温下易卷毛（E错，为本题的正确答案），因此不可浸泡在沸水中或用煮沸法消毒。尼龙丝具有很高的机械强度，细软，弹性好（B对），耐磨损（C对），吸水性差（D对），无毒无味，易洗涤和干燥等均为尼龙丝作为刷毛的优点。毛端呈圆形，对牙齿起清洁作用，刷毛较软对牙齿牙龈更加柔和而起按摩作用（A对）。